儿科护士发现医嘱有错，询问医生，医生呵斥护士不信任自己，并嘱其应遵循医嘱内容，该医生的行为违背了什么原则
A. 相互平等，相互尊重
B. 工作严谨
C. 维护患者利益
D. 相互信任、相互协作
E. 相互学习，提高技能

正确答案：A。相互平等，相互尊重

解析：儿科护士发现医嘱有错，询问医生，医生呵斥护士不信任自己，并嘱其应遵循医嘱内容，该医生的行为的不尊重护士，违背了相互平等，相互尊重（A对）原则。工作严谨（B错）一般指的是工作有理有据，严谨甚微。维护患者利益（C错）一般指的是医护工作人员应当站在患者的角度，为患者考虑，谋福利。相互信任、相互协作（D错）一般指的是医护工作人员之间应该遵从的准则，互相信任对方，协作完成医疗任务。相互学习，提高技能（E错）一般指的是医护工作人员之间应当互相学习，以提高职业技能为重。